辅酶和辅基的差别在于
A. 辅酶为小分子有机物，辅基常为无机物
B. 辅酶与酶共价结合，辅基则不是
C. 经透析方法可使辅酶与酶蛋白分离，辅基则不能
D. 辅酶参与酶反应，辅基则不参与
E. 辅酶含有维生素成分，辅基则不含

正确答案：C。经透析方法可使辅酶与酶蛋白分离，辅基则不能